下列不属于社会卫生状况评价的人口学指标是
A. 人口自然增长率
B. 人口负担系数
C. 老龄化指数
D. 年龄中位数
E. 离婚率

正确答案：E。离婚率